以下是基层职业卫生工作的主要内容，除外
A. 现场劳动卫生调查和职业流行病学调查
B. 制定有关法规、条例和卫生标准
C. 生产环境监测
D. 人员培训和宣传教育
E. 对劳动者进行健康监护

正确答案：B。制定有关法规、条例和卫生标准